纤维粉尘是指纵横径之比
A. ＞10:1
B. ＞5:1
C. ＞3:1
D. ＜3:1
E. ＞2:1

正确答案：C。＞3:1

解析：本题考查纤维粉尘的概念。纤维是指纵横径之比大于3∶1（C对ABDE错）的粉尘。直径≥3㎛，长度≥5㎛的纤维是非可吸入性纤维。直径＜3㎛，长度≥5㎛的纤维是可吸入性纤维。